以性器官、第二性征的迅速发育为特征的阶段是
A. 青春期
B. 青春早期
C. 青春中期
D. 青春后期
E. 青年期

正确答案：C。青春中期